关于蔬菜中的维生素含量的描述正确的是
A. 根茎部含量较叶部高，嫩叶比枯老叶高，深色菜叶比浅色菜叶高
B. 叶部含量较根茎部高，嫩叶比枯老叶高，深色菜叶比浅色菜叶高
C. 叶部含量较根茎部高，枯老叶比嫩叶高，深色菜叶比浅色菜叶高
D. 根茎部含量较叶部高，嫩叶比枯老叶高，浅色菜叶比深色菜叶高
E. 叶部含量较根茎部高，嫩叶比枯老叶高，浅色菜叶比深色菜叶高

正确答案：B。叶部含量较根茎部高，嫩叶比枯老叶高，深色菜叶比浅色菜叶高

解析：本题考查蔬菜中的维生素含量。蔬菜中的维生素含量与品种、鲜嫩程度和颜色有关，一般叶部含量较根茎部高，嫩叶比枯老叶高，深色菜叶比浅色菜叶高（B对ACDE错）。